能养血补气、调经止痛的中成药是
A. 逍遥丸
B. 当归丸
C. 养血调经膏
D. 七制香附丸
E. 暖宫七味丸

正确答案：B。当归丸